患者，女，60岁。因全身关节疼痛，长期服用某药，昨日边现，自发性骨折，导致该不良反应的药物是
A. 泼尼松
B. 阿司匹林
C. 消炎痛
D. 保泰松
E. 布洛芬

正确答案：A。泼尼松

解析：泼尼松属于糖皮质激素类药物，具有抗炎和免疫抑制的作用，临床可用于风湿性以及类风湿性关节炎，但长期使用糖皮质激素会减少钙、磷的吸收并增加其排泄，且长期使用抑制骨细胞活力，造成骨质疏松，儿童、绝经期妇女、老年人较多见，严重者可引起自发性骨折（A对），可补充维生素D和钙盐进行预防。阿司匹林（B错）主要不良反应为胃肠道反应，引起上腹不适、恶心、呕吐，较大剂量口服可加重、诱发溃疡，引起胃出血，敏感患者还会出现水杨酸反应、过敏反应等。消炎痛（C错）又名吲哚美辛，主要的不良反应为胃肠道反应、头痛、眩晕、精神异常、造血功能抑制、过敏反应。保泰松（D错）毒性较大，引起胃肠道反应，水钠潴留，肝肾损害，长期使用可抑制骨髓造血功能。布洛芬（E错）常见的不良反应为胃肠道反应，易耐受，偶见血小板减少症、视力模糊等。